女性，27岁。诉全口牙龈肿胀、出血不止、疼痛明显3天。口腔检查：全口牙龈肿大波及牙间乳头、边缘龈和附着龈，颜色苍白，龈缘处有坏死溃疡，局部有渗血。口腔黏膜上可见出血点。血常规示：白细胞数异常增加并出现不成熟白细胞。初步诊断为：急性白血病的牙龈表现。下列处理中哪项是错误的
A. 应及时与内科医生配合治疗
B. 口腔治疗应为保守治疗
C. 如需要可行手术或活体组织病理检查
D. 出血可用局部压迫或药物止血
E. 局部用3％过氧化氢溶液轻轻冲洗

正确答案：C。如需要可行手术或活体组织病理检查

解析：本题考查白血病的牙龈病损的治疗。初步诊断为：急性白血病的牙龈表现。下列处理中错误的是如需要可行手术或活体组织病理检查（C错，为本题的正确答案）。在可疑或已确诊为白血病时，应及时与内科医师配合进行治疗（A对）。牙周的治疗以保守为主（B对），切忌进行手术或活组织检查，以免发生出血不止或感染、坏死。遇出血不止时，可采用局部压迫方法或药物止血（D对），必要时可放牙周塞治剂观察数天，切实止血后再拆除塞治剂。在无出血情况下，可用3%过氧化氢溶液轻轻清洗坏死龈缘（E对），然后敷以消炎药或碘制剂，用0.12%～0.2%氯已定液含漱有助于减少菌斑、消除炎症。对急性白血病患者一般不做洁治，若全身情况允许，必要时可进行简单的洁治术，但应特别注意动作轻柔，避免引起出血和组织创伤。对患者进行口腔卫生指导，加强口腔护理，防止菌斑堆积，减轻炎症。